非处方药与处方药不同之处在于
A. 患者自我诊断疾病
B. 购药不用处方
C. 不能在大众传播媒介作广告宣传
D. 有专利保护期
E. 口服、外用为主

正确答案：A、B、E。患者自我诊断疾病；购药不用处方；口服、外用为主

解析：本题考查处方药与非处方药。非处方药与处方药不同之处在于：患者自我诊断疾病（A对）；购药不用处方（B对）；口服、外用为主（E对）。处方药品和非处方药品的不同之处：1.处方药是指凭执业医师和执业助理医师处方方可购买、调配和使用的药品。它是由国家卫生行政部门规定和审定的，需凭医师或是由具有处方权的医疗机构专业人员开出处方，并在医师、药师或是其他专业医疗人员监督指导下使用的药品。而非处方药是指由国家药品监督管理局公布的，不需要凭执业医师和执业助理医师处方，消费者可以自行判断、购买和使用的药品。也就是说，属于这类非处方类别的药品，消费者和使用者是可以根据药品说明书，进行自选、自购、自用的。2.疾病诊断者：处方药是医生；非处方药是患者自我诊断。3.疾病类型：处方药用于病情较重，需经医生诊断；非处方药治疗小伤小病解除症状，慢性病维持治疗。4.取药凭据：处方药医生处方；非处方不需处方。5.服药天数：处方药长；非处方短。6.给药途径：处方药根据病情和医执行；非处方口服、外用为主。非处方药可以在大众媒介上进行广告宣传（C错），但广告内容必须经过审查、批准，不能任意夸大或篡改。处方药具有品牌与专利保护期，而非处方药只有品牌保护期（D错）。